男，40岁，因反复机会性感染入院，检查发现患者伴发卡波西肉瘤，诊断应首先考虑
A. 先天性胸腺发育不全
B. 腺苷脱氨酶缺乏症
C. X-性连锁低丙球血症
D. 艾滋病
E. 选择性IgA缺乏症

正确答案：D。艾滋病

解析：40岁男性，反复机会性感染入院（HIV感染艾滋病期临床表现），检查发现患者伴发卡波西肉瘤（艾滋病易伴发），诊断应首先考虑艾滋病（AIDS）（D对），即获得性免疫缺陷综合征，系由人类免疫缺陷病毒（HIV）引起的慢性传染性疾病。HIV会导致机体免疫细胞或（和）功能受损乃至缺陷，最终并发各种机会性感染和肿瘤，如卡波西肉瘤（为艾滋病的诊断标准之一）、淋巴瘤等，具有传播迅速，发病缓慢，病死率高的特点呢。先天性胸腺发育不全（A错），又名DiGeorge综合征或第3、4对咽囊综合征，因先天胸腺发育不全，缺乏T细胞，极易反复发生病毒性和真菌性感染，甚至死亡，患儿出生后常有特殊面貌，顽固性低血钙搐搦症，主动脉弓异常（八版医学免疫学P14）。腺苷脱氨酶（ADA）缺乏症（B错），属于一种严重联合性免疫缺陷病（SCID），由于ADA的缺乏，使T、B细胞发育不全和产生功能障碍，导致严重细胞、体液免疫缺陷，还表现为骨生长停止和神经功能损害、肾脏、肾上腺损害等（六版医学遗传学P189-P190）。X-性连锁低丙球血症（C错）的特征是血液循环中缺乏B细胞和γ球蛋白，较常见于男性新生儿，患儿出生6个月后开始出现症状，表现为反复感染，包括肺炎、支气管炎、脑膜炎和败血症等（六版医学遗传学P189）。选择性IgA缺乏症（E错）指血清IgA低于0.05g/L，而IgG和IgM含量正常，该病的遗传方式为常染色体隐性遗传，大部分患者无明显症状，少部分患者伴有呼吸道、胃肠道、泌尿道的细菌或病毒感染，消化不良，50%患者血清中出现抗食物蛋白抗体（六版医学遗传学P189）。